前置胎盘病例，仅适用于阴道分娩的是
A. 部分性前置胎盘而胎儿为头位
B. 边缘性前置胎盘而胎儿为头位
C. 部分性前置胎盘而胎儿为臀位
D. 低置前置胎盘而胎儿为臀位
E. 以上都不是

正确答案：B。边缘性前置胎盘而胎儿为头位

解析：边缘性前置胎盘而胎儿为头位适用于阴道分娩（B对E错）。部分性前置胎盘而胎儿为头位（A错）、部分性前置胎盘而胎儿为臀位（C错）出血量较多，先露高浮，仅适用于剖宫产。低置前置胎盘（P126），胎盘下缘与宫颈内口的关系可因宫颈管消失、宫口扩张而改变，因此低置前置胎盘而胎儿为臀位（D错）经阴道分娩或剖宫产应视情况而定。